以下哪项是指对个体或群体的健康进行全面监测、分析、评估、提供健康咨询、指导以及对健康危险因素进行干预的全过程
A. 健康管理
B. 健康咨询
C. 健康教育
D. 健康评估
E. 疾病预防

正确答案：A。健康管理

解析：健康管理是指对个体或群体的健康进行全面监测、分析、评估、提供健康咨询、指导以及对健康危险因素进行干预的全过程。掌握“临床预防服务概述”知识点。